属于α受体阻断药的是
A. 新斯的明
B. 异丙肾上腺素
C. 可乐定
D. 阿托品
E. 酚妥拉明

正确答案：E。酚妥拉明